在白细胞分类计数（DC）正常值参考范围内，中性粒细胞的高限是
A. 0.4
B. 0.5
C. 0.6
D. 0.7
E. 0.8

正确答案：D。0.7

解析：本题考查血常规检查。在白细胞分类计数（DC）正常值参考范围内，中性粒细胞的高限是0.7（D对）。中性粒细胞的正常参考范围为0.50～0.70（50%～70%），故其高限是0.7。